大腹子的正名是
A. 马钱子
B. 枳实
C. 补骨脂
D. 槟榔
E. 茺蔚子

正确答案：D。槟榔

解析：本题考查的是常见的饮片正名与相关别名。大腹子的正名是槟榔（D对）。槟榔别名：花槟榔、大腹子、海南子。马钱子（A错）别名：番木鳖、马前、马前子。补骨脂（C错）别名：破故纸。茺蔚子（E错）别名：益母草子、坤草子。枳实（B错）的别名，2022年考试指南未明确说明。